乳母长期营养不良，乳汁中成分含量改变较显著的是
A. 铁
B. 钙
C. 维生素D
D. 乳糖
E. 蛋白质

正确答案：E。蛋白质